对3000人进行随访，暴露于A因子的1000人中，100人发生某病，而未暴露于A因子的2000人中也有100人发生某病，则因暴露所致的超额危险度（归因危险度）是
A. 0
B. 50‰
C. 180‰
D. 250‰
E. 不能计算

正确答案：B。50‰

解析：本题考查归因危险度的计算。归因危险度（AR），是暴露组发病率与对照组发病率相差的绝对值。题中归因危险度＝100/1000－100/2000＝50‰（B对ACDE错）。